女孩，5岁。精神欠佳半个月，发热、头痛、呕吐10天。半个月前开始出现精神不佳，10天来每天发热，最高体温38.1℃，进食减少，伴头痛、呕吐。2个月前曾患“麻疹”。查体：精神差，消瘦，右眼外展受限，颈抵抗（+），Kernig征（+），Brudzinski征（+），PPD试验（-）。提示该疾病进入晚期的表现
A. 颅神经受损
B. 肢体偏瘫
C. 惊厥
D. 昏迷
E. 腹壁反射消失

正确答案：D。昏迷

解析：5岁患儿，精神欠佳半个月，发热、头痛、呕吐10天（结核性脑膜炎早期表现）。半个月前开始出现精神不佳，10天来每天发热，最高体温38.1℃，进食减少，伴头痛、呕吐（脑膜刺激期）。2个月前曾患“麻疹”（近期急性传染病史）。查体：精神差，消瘦，右眼外展受限，颈抵抗（+），Kernig征（+），Brudzinski征（+）（脑膜刺激征阳性），PPD试验（-）（结核性脑膜炎50%的患儿可呈阴性反应）。根据患者的病史、临床表现、辅助检查，目前的诊断考虑为结核性脑膜炎。昏迷（D对）是结核性脑膜炎晚期的表现，结核性脑膜炎晚期又叫昏迷期。